结合反应主要在（）进行
A. 肾脏
B. 肝脏
C. 肺
D. 肠

正确答案：B。肝脏

解析：本题考查结合反应的主要部位。结合反应主要在肝脏（B对ACD错）进行，其次为肾脏，也可在肺、肠、脾、脑等组织器官中发生。